男，57岁。反复咳嗽，咳痰10余年，加重伴喘憋3余年。吸烟10年，20支/日。查体：桶状胸，双肺呼吸音低，叩诊过清音，未闻及干湿啰音。动脉血气分析：pH7.39，PaO₂65mmHg，PaCO₂43mmHg，肺功能检查：FEV₁占预计值52%，FEV₁/FVC=51%，造成该患者换气功能障碍的主要病理生理机制是
A. 肺内功能性分流减少
B. 肺弥散面积增大
C. 肺脏非弹性阻力减少
D. 肺脏无效腔减少
E. 弥散功能障碍

正确答案：E。弥散功能障碍

解析：患者老年男性，反复咳嗽，咳痰10余年，加重伴喘憋3余年（COPD常见表现）。查体：桶状胸（肺气肿特征性体征），双肺呼吸音低，叩诊过清音，未闻及干湿啰音（排除肺部炎症）。动脉血气分析：pH7.39（正常pH7.35～7.45），PaO₂65mmHg（正常PaO₂95～100mmHg），PaCO₂43mmHg（正常PaCO₂35～45mmHg），肺功能检查：FEV₁，占预计值52%（FEV₁，占预计值＜80%），FEV₁/FVC=51%（FEV₁/FVC＜0.70），结合临床表现和检查可诊断为COPD。COPD特征性的病理生理变化是持续气流受限致肺通气功能障碍，随着病情的发展，肺弹性组织弹性日益减退，肺泡持续扩大，残气量增加，肺泡受压导致肺泡周围毛细血管减少，肺弥散面积减少（E对B错），肺内功能性分流增加（A错），肺泡非弹性阻力增加（C错），肺脏无效腔增加（D错）。